单室模型静脉注射给药后体内血药浓度随时间变化的关系式
A. C=k₀（1-e-kt）/Vk
B. logC＇=（-k/2.303）t＇+log（k₀/Vk）
C. logC＇=（-k/2.303）t＇+log[k₀（1-e-kt）/Vk]
D. logC=（-k/2.303）t+logC₀
E. logX=（-k/2.303）t+logX₀

正确答案：D。logC=（-k/2.303）t+logC₀